横切面显微鉴定可见油细胞层的药材有
A. 槟榔
B. 马钱子
C. 砂仁
D. 豆蔻
E. 苦杏仁

正确答案：C、D。砂仁；豆蔻

解析：本题考查砂仁和豆蔻横切面的显微鉴别。横切面显微鉴定可见油细胞层的药材有砂仁（C对）、豆蔻（D对）。砂仁【显微鉴别】阳春砂种子横切面：①假种皮有时残存。②种皮表皮细胞1列，径向延长，壁稍厚；下皮细胞1列，含棕色或红棕色物；油细胞层细胞1列，呈切向长方形，长76～106㎛，宽16～25㎛，含黄色油滴。色素层为数列棕色细胞，细胞多角形，排列不规则。内种皮为1列栅状厚壁细胞，黄棕色，内壁及侧壁极厚，细胞小，内含硅质块。③外胚乳细胞含淀粉粒，并有少数细小的草酸钙方晶。④内胚乳细胞含细小的糊粉粒及脂肪油滴。豆蔻【显微鉴别】白豆蔻种子横切面：①假种皮为长形薄壁细胞，部分已剥落。②种皮表皮细胞径向延长，壁较厚；色素层常为2列细胞，壁厚，多切向延长；油细胞层细胞l列，类方形，壁薄，径向长32～104㎛，切向长16～96㎛，内含油滴；色素层为数列压扁的细胞，内含红棕色物质；内种皮为1列石细胞，内壁及侧壁极厚，胞腔偏于外侧。种脊维管束位于凹端处。③外胚乳细胞含淀粉粒及少数草酸钙结晶。④内胚乳细胞含糊粉粒。⑤胚位于内胚乳中央。槟榔（A错）【显微鉴别】横切面：①种皮组织分内、外两层，外层为数列切向延长的扁平石细胞，内含红棕色物，石细胞形状、大小不一，常有细胞间隙；内层为数列薄壁细胞，内含棕红色物，并散有少数维管束。②外胚乳较狭窄，细胞含黑棕色物；种皮内层与外胚乳的折合层常不规则地插入内胚乳中，形成错入组织。内胚乳细胞类白色，多角形，壁厚，纹孔大，含油滴及糊粉粒。马钱子（B错）【显微鉴别】刮取种子表皮毛茸少许，封藏在间苯三酚及盐酸中，置显微镜下观察：被染成红色的表皮细胞所形成的单细胞毛茸，细胞壁厚，强烈木化，具纵条纹，毛茸基部膨大略似石细胞样，但多数已折断。马钱种子的表皮毛茸平直不扭曲，毛肋不分散。苦杏仁（E错）【显微鉴别】横切面：①种皮表皮为1层薄壁细胞，散有近圆形的橙黄色石细胞，内为多层薄壁细胞，有小型维管束通过。②外胚乳为一薄层颓废细胞。③内胚乳为1至数层方形细胞，内含糊粉粒及脂肪油。④子叶为多角形薄壁细胞，含糊粉粒及脂肪油。